下列哪项不是诊断氟牙症的依据
A. 釉质中的氟含量过高
B. 骨组织中的氟含量过高
C. 牙面黄染
D. 双侧对称性病变
E. 在高氟区的生活史

正确答案：C。牙面黄染

解析：由于其他因素也可导致类似的釉质损伤，确诊氟牙症需要看到病变缺陷为双侧、有先前过度摄入氟的病史以及釉质或其他组织中氟含量增高的证据。掌握“氟牙症、先天性梅毒牙与牙本质形成缺陷”知识点。